二级信息源包括
A. 期刊杂志
B. 数据库
C. 国内文摘
D. 国外文摘
E. 专业指南

正确答案：B、C、D。数据库；国内文摘；国外文摘

解析：本题考查药物信息的分类。数据库（B对）、国内文摘（C对）、国外文摘（D对）均为二级信息源。期刊杂志（A错）为一级信息源。专业指南（E错）为三级信息源。药学信息按照其最初来源通常分为三级：一级信息资源（一次文献）即原创性论著，包括实验研究结果、病例报道以及评价性的或描述性的科学研究结果；二级信息资源（二级文献）是对原创性论著进行加工，主要用于检索一级文献，一般由引文书目组成，可提供摘要、引文、索引（包括或不包括全文）及目录；三级信息资源（三次文献）是在一级、二级文献的基础上归纳、综合、整理后的结果，包括医药图书（工具书、教科书、手册等）、光盘或在线数据库等。